脾肾韧带
A. 位于左肾后缘至脾门之间
B. 为单层腹膜结构
C. 含胃血管
D. 含脾血管
E. 含胰体

正确答案：D。含脾血管

解析：脾肾韧带位于左肾前面至脾门（A错）之间，为双层腹膜结构（B错），内含胰尾（E错）、脾血管（C错,D对）